一患者下颌右5678缺失，胶连式义齿修复，右下4三臂卡，左下47隙卡。义齿戴用一周后，主诉义齿游离端压痛、咀嚼不适。口腔内检查发现：义齿各部分均密合，固位及稳定性好，咬合无高点，基托伸展不影响软组织活动，缺隙黏膜无明显压痛点、红肿或溃疡。造成义齿压痛的原因是
A. 卡环固位力差
B. 基托下沉
C. 基托翘动
D. 牙槽嵴负担过重
E. 使用不当

正确答案：D。牙槽嵴负担过重

解析：本题考查造成义齿压痛的原因。该患者右下5678均缺失，只选择右下4放置（牙合）支托，会因（牙合）支托较少，牙槽嵴负担过重（D对）导致游离端压痛。可摘局部义齿戴入后出现游离端压痛，经检查：义齿各部分均密合，固位及稳定性好，即卡环固位好（A错）、稳定性好，无翘起（C错）、摆动、旋转、下沉（B错）现象，咬合无高点，基托伸展不影响软组织活动，缺隙黏膜无明显压痛点、红肿或溃疡可排除义齿早接触点及基托边缘问题导致的疼痛。当缺牙过多，（牙合）支托少时，基牙分担的（牙合）力较少，相应的，牙槽嵴分担的（牙合）力增大，可引起较大面积黏膜压痛及黏膜红肿。义齿使用不当（E错）可能造成义齿变形、折断等问题，不会造成游离端压痛等。